病例对照研究与队列研究的共同点是
A. 是前瞻性的
B. 从因到果
C. 设立比较组
D. 均适用于罕见病调查
E. 检验病因假设的强度相近

正确答案：C。设立比较组